《中国药典》规定，黄芪含量测定的指标成分是
A. 黄芪皂苷甲和黄芪皂苷乙
B. 黄芪皂苷甲和异黄芪苷Ⅰ
C. 黄芪皂苷乙和大豆皂苷Ⅰ
D. 黄芪甲苷和毛蕊异黄酮葡萄糖苷
E. 黄芪甲苷和乙酰黄芪苷Ⅰ

正确答案：D。黄芪甲苷和毛蕊异黄酮葡萄糖苷

解析：本题考查的是黄芪的化学成分。《中国药典》规定，黄芪含量测定的指标成分是黄芪甲苷和毛蕊异黄酮葡萄糖苷（D对）。黄芪的化学成分众多，主要含皂苷类、黄酮类、多糖类及氨基酸类等。《中国药典》以黄芪甲苷和毛蕊异黄酮葡萄糖苷为指标成分进行药材和饮片的含量测定，要求药材含黄芪甲苷不得少于0.080%，含黄芪甲苷不得少于0.060%；要求药材和饮片含毛蕊异黄酮葡萄糖苷不得少于0.020%。